光照左眼，两眼瞳孔左侧缩小，右侧不缩小；光照右眼，右侧瞳孔不缩小，左侧缩小，病变在
A. 右视束
B. 右动眼神经
C. 右侧视神经
D. 左视神经
E. 无

正确答案：B。右动眼神经

解析：一侧视神经受损时，光照患侧眼的瞳孔，两侧瞳孔均不反应；但光照健侧眼的瞳孔，则两眼对光反射均存在，一侧动眼神经受损时，无论光照哪一侧眼，患侧眼的瞳孔对 光反射都消失，但健侧眼的瞳孔直接和间接对光反射存在，本题患者光照左眼，两眼瞳孔左侧缩小，右侧不缩小；光照右眼，右侧瞳孔不缩小，左侧缩小，应考虑病变在右动眼神经（B对）。